男，32岁。炸石作业时不慎炸伤右大腿5小时。伤后出血约400ml。查体：T36.5℃，P80次/分，R18次/分，BP110/80mmHg，神志清楚，双肺呼吸音清，未闻及干湿性啰音，心律齐，腹软，无压痛。右大腿可见一长约10cm不规则皮肤伤口，肌肉部分破损。对该患者处理错误的是
A. 清创后一期缝合伤口
B. 扩创、引流后延期缝合
C. 同时应用抗生素和TAT
D. 清创时探查深部组织损伤情况
E. 伤口近心端扎止血带，送医院

正确答案：A。清创后一期缝合伤口

解析：该患者右大腿被炸伤，为火器伤，局部治疗主要是尽早清创，充分显露伤道，清除坏死和失活的组织，清创时探查深部组织损伤情况（D对），虽然受伤时间仅为5小时，但治疗时清创后不宜一期缝合（A错，为本题正确答案），因为初期清创后，挫伤区和震荡区参差交错，不易判断。火器伤无论伤后多长时间，除颜面伤、头皮伤、关节伤等损伤外，一律清创后开放引流₊延期缝合，即扩创、引流后延期缝合（B对），同时应用抗生素和TAT（C对）。伤口近心端扎止血带，送医院（E对）治疗。